败毒散的组成药物中不包括
A. 柴胡、前胡
B. 羌活、独活
C. 桔梗、枳壳
D. 人参、甘草
E. 当归、芍药

正确答案：E。当归、芍药

解析：本题考查败毒散的组成，属于记忆内容。败毒散功用散寒祛湿，益气解表，由柴胡、前胡、川芎、枳壳、羌活、独活、茯苓 、桔梗、人参、甘草组成。当归、芍药不包括于败毒散中（E对）。记忆：人参败毒草苓穹，羌独柴前枳桔同，薄荷少许姜三片，气虚感寒有奇功。